上颌前牙的远中向倾斜角度为
A. 中切牙=侧切牙=尖牙
B. 中切牙＞侧切牙＞尖牙
C. 中切牙＞尖牙＞侧切牙
D. 侧切牙＞尖牙＞中切牙
E. 尖牙＞侧切牙＞中切牙

正确答案：D。侧切牙＞尖牙＞中切牙

解析：本题考查上颌前牙的远中向倾斜角度。上颌侧切牙颈部的舌向和远中向倾斜皆大于上颌中切牙，上颌尖牙倾斜度介于上颌中切牙和上颌侧切牙之间，即侧切牙＞尖牙＞中切牙（D对），全口义齿修复上颌前牙排牙时远中向的倾斜规律与自然牙列一致，不仅有利于前牙的美观自然，而且有利于排列成平衡（牙合），保护口腔组织的健康，增强义齿的稳定性。